下列哪项是白虎汤的治疗禁忌
A. 腹满身重
B. 谵语
C. 肢冷胸腹灼热
D. 发热无汗脉浮
E. 遗尿

正确答案：D。发热无汗脉浮

解析：伤寒脉浮，发热无汗，为太阳伤寒，当用辛温发表之法。其表不解，即使兼有内热，也当在发汗解表以后再议清里，而不可径用白虎汤（D对）。若误用之，极易造成变证，故前人有“无汗不得用白虎”的诫语。只有当外无表寒，而里热已盛，且又伴津气两伤的渴欲饮水诸证时，才宜用白虎加人参汤，清里热，益气津。